患者女性，45岁，血压160/95mmHg以上，已持续2年。现眩晕头痛，腰膝酸软，耳鸣多梦，心烦易怒，苦咽干，手足心热，舌红少苔，脉弦细数。其证型是
A. 痰浊中阻
B. 阴阳两虚
C. 肝火亢盛
D. 肝风上扰
E. 阴虚阳亢

正确答案：E。阴虚阳亢

解析：患者血压160/95mmHg以上，已持续2年，（达到高血压诊断标准：在未服用抗高血压药物的情况下，非同日3次血压测量值收缩压均≥140mmHg和（或）舒张压≥90mmHg者即可确诊为高血压）。患者肝阳上逆，气血上冲故见眩晕头痛；肝肾阴亏，腰膝失养故见腰膝酸软；阴液不足，头目失养故见耳鸣；火热内扰，心神不安故见心烦易怒，多梦；肝火炽盛，循经上扰故见口苦咽干；虚火内炽故见手足心热；阴虚阳亢故见舌红少苔，脉弦细数（E对）。痰浊中阻型眩晕见头重如蒙，胸闷恶心，食少多寐，苔白腻，脉濡滑（A错）。阴阳两虚型眩晕见头晕乏力，面白无华，手足心热，寐差，腰膝酸软（B错）。肝火亢盛型眩晕见头晕头痛，口干口苦，而红目赤，烦躁易怒，大便秘结，小便黄赤，舌质红，苔薄黄，脉弦细有力（C错）。肝风上扰型见眩晕、震颤或手足蠕动，或昏仆（D错）。